ATP合成部位在
A. 线粒体外膜
B. 线粒体内膜
C. 线粒体膜间腔
D. 线粒体基质
E. 线粒体内膜F1F0复合体

正确答案：E。线粒体内膜F1F0复合体